胃后动脉多数源于
A. 肝总动脉
B. 脾动脉
C. 胰动脉
D. 胃十二指肠动脉
E. 肠系膜上动脉

正确答案：B。脾动脉

解析：脾动脉（B对）发出分支为胃后动脉，行于网膜囊后壁的腹膜后面，经胃膈韧带至胃底。